慢性阻塞性肺部疾患包括
A. 慢性支气管炎、支气管哮喘、肺气肿
B. 慢性支气管炎、慢性鼻炎、慢性肺炎
C. 慢性支气管炎、慢性肺炎、肺水肿
D. 慢性支气管炎、肺水肿
E. 慢性支气管炎、肺气肿

正确答案：E。慢性支气管炎、肺气肿